噎膈的发病机理主要是
A. 脾胃俱伤
B. 肺胃两伤
C. 气血郁结
D. 本虚标实
E. 气痰瘀交结，阻于食管、胃脘

正确答案：E。气痰瘀交结，阻于食管、胃脘

解析：噎膈的基本病机是各种原因导致的气、痰、瘀交阻于食道与胃脘，导致食管狭窄，胃失通降（E对）。